男，46岁，既往有溃疡病史，突发上腹部剧痛，呈“刀割样”，腹痛迅速波及全腹，病人面色苍白，出冷汗，常伴有恶心、呕吐，严重时可伴有血压下降。首选检查是
A. X线检查
B. 幽门螺杆菌检测
C. C13
D. Pet-CT
E. 腹部MRI

正确答案：A。X线检查

解析：该患者男，46岁，既往有溃疡病史，结合该患者出现的表现，应诊断为消化性溃疡并穿孔，首选检查是X线检查（A对）。幽门螺杆菌检测、C13用于检测胃内是否存在幽门螺杆菌（BC错），CT、腹部MRI并不是消化性溃疡的首选检查（DE错）。